诊断阵发性睡眠性血红蛋白尿最有意义的血细胞膜免疫标志是
A. CD19、CD20
B. CD3、CD4
C. CD33、CD34
D. CD3、CD8
E. CD55、CD59

正确答案：E。CD55、CD59

解析：阵发性睡眠性血红蛋白尿是由于造血干细胞基因缺陷导致血细胞膜上的糖化磷脂酰肌醇锚合成障碍，使红细胞易被补体破坏而发生血管内溶血，CD55和CD59是最重要的糖化磷脂酰肌醇（GPI）锚连膜蛋白，阵发性睡眠性血红蛋白尿时GPI锚连膜蛋白部分或全部丢失，故诊断阵发性睡眠性血红蛋白尿最有意义的血细胞膜免疫学标志是CD55、CD59（E对）。CD19、CD20（P572）（A错）是B细胞的免疫学标记，CD3、CD4、CD8（P572）（BD错）是T细胞的免疫学标记，CD33、CD34（C错）是髓系细胞的免疫标记。